牙周病的全身易感因素不包括
A. 遗传因素
B. 免疫功能
C. 某些全身疾病
D. 吸烟
E. 酗酒

正确答案：E。酗酒

解析：本题考查牙周疾病促进因素。牙周病的全身易感因素不包括酗酒（E错，为本题正确答案）。牙周病的全身促进因素（易感因素）主要有：遗传因素（A对）、性激素、吸烟（D对）及免疫功能（B对）、有关的系统疾病（C对）。酗酒不是考虑的因素。